自我药疗时，抗真菌药用于阴道炎，连续用药时间不宜超过
A. 1日
B. 3日
C. 5日
D. 7日
E. 10日

正确答案：E。10日

解析：本题考查抗真菌药的使用。阴道连续用药不宜超过10天（E对）。